中医对子宫脱垂的称谓，错误的是
A. 阴挺
B. 阴颓
C. 阴菌
D. 阴覃
E. 阴茧

正确答案：E。阴茧

解析：外阴溃疡中医称为阴疮、阴蚀、阴茧（E错，为本题正确答案）；子宫脱垂又名子宫脱出、阴挺、阴脱、阴癫、阴颓、阴蕈、瘣疾、子宫不收、子肠不收、翻花（ABCD对）。